饮水中六六六、DDT标准制订的依据是
A. 慢性蓄积作用及致癌作用
B. 慢性蓄积作用及致敏作用
C. 神经毒性作用
D. 恶化水质感官性状
E. 急性毒作用

正确答案：A。慢性蓄积作用及致癌作用

解析：本题考查饮水中六六六、DDT标准制订的依据。六六六、DDT均是有机氯农药,化学性质稳定，难易降解，易通过食物链在人体蓄积，具有慢性蓄积作用。目前有很多研究结果表明，长期暴露于六六六和DDT，可能对人体产生致癌效应，特别是对肝脏、肾脏、甲状腺和前列腺等器官的损害最为显著。因此，饮水中六六六、DDT标准制订的依据是慢性蓄积作用及致癌作用（A对BCDE错）。